在确定固定修复体龈缘位置时，不必考虑的因素为
A. （牙合）力大小
B. 牙周健康状态
C. 口腔卫生状态
D. 美观
E. 年龄

正确答案：A。（牙合）力大小

解析：本题考查确定固定修复体龈缘位置的考虑因素。在确定固定修复体龈缘位置时，不必考虑（牙合）力大小（A错，为本题的正确答案），因为龈边缘的位置通常对（牙合）力没有影响。在确定固定修复体龈缘位置时，需要考虑的因素有：1.牙周健康状态（B对），龈下边缘易积存食物，形成菌斑，以致破坏上皮附着，加深龈袋，产生牙周炎；2.口腔卫生状态（C对），龈边缘的位置应保证口腔的自洁作用以及便于洗刷；3.美观（D对），龈下边缘由于不会露出金属边缘等，比较美观；4.年龄（E对），尤其年轻人对美观要求较老年人高，故常选用龈下边缘。